联合使用可提高芍药甘草汤疗效的西药是
A. 解痉药
B. 强心药
C. 抗癫痫药
D. 抗高血压药
E. 血管扩张药

正确答案：A。解痉药

解析：本题考查的是中西药合理联用的协同增效。联合使用可提高芍药甘草汤疗效的西药是解痉药（A对）。芍药甘草汤等与西药解痉药联用，可提高疗效。强心药（B错）地高辛等与木防己汤、茯苓杏仁甘草汤、四逆汤等联用，可以提高疗效和改善心功能不全患者的自觉症状。苯妥英钠等抗癫痫药（C错）与石菖蒲、地龙联用，能提高抗癫痫的效果。抗高血压药（D错）甲基多巴、卡托普利等与钩藤散、柴胡加龙骨牡蛎汤等联用，有利于提高对老年高血压的治疗效果。血管扩张药（E错）与桂枝茯苓丸、当归四逆加吴茱萸生姜汤等联用，可增强作用，其中的中药方剂对于微循环系统的血管扩张特别有效。